女，32岁。低热、盗汗、腹胀1个月，阵发性腹部绞痛，伴停止排气及排便10小时。该患者最可能的诊断是
A. 结核性腹膜炎并肠梗阻
B. 肠梗阻合并肠穿孔
C. 肠扭转
D. 急性腹膜炎合并肠穿孔
E. 急性腹膜炎

正确答案：A。结核性腹膜炎并肠梗阻

解析：青年女性患者，低热、盗汗（结核中毒症状），阵发性腹部绞痛，伴停止排气、排便（提示肠梗阻），最可能的诊断是结核性腹膜炎并肠梗阻（A对）。结核性腹膜炎多见于中青年，以低热、盗汗、腹痛、腹胀为主要表现，可并发肠梗阻、肠瘘等。肠穿孔（BD错）表现为突发的腹部剧痛，并迅速波及全腹，常伴恶心、呕吐，查体有腹部压痛、反跳痛，肠鸣音减弱或消失；肠扭转（C错）多见于体位的突然改变或剧烈运动过程中，表现为突然发作的剧烈腹痛，呈持续性伴阵发性加剧，早期可出现休克；急性腹膜炎（E错）以腹部压痛、反跳痛和腹肌紧张（即腹膜刺激征）为典型表现，上述疾病均不会出现低热、盗汗等表现。